肝脾不和、腹部挛急作痛宜用
A. 石决明
B. 代赭石
C. 生龙骨
D. 杭白芍
E. 灵磁石

正确答案：D。杭白芍

解析：杭白芍甘补酸敛，苦泄微寒，入肝、脾经。既养血调经、柔肝止痛，又敛阴止汗、平抑肝阳，略兼清热，主治阴血亏虚、肝急、阳亢诸证，兼治体虚多汗等证。可调肝理脾，治疗脾虚肝旺，腹痛泄泻（D对）。石决明（A错）善平肝潜阳、清肝明目，为治肝阳上亢及肝热目疾之要药。代赭石（B错）入肝经，善镇潜平肝，治肝阳上亢。入肺、胃经，善降肺胃之逆，治呕呃喘息。入心经，善凉血止血，治血热气逆之吐衄。生龙骨（C错）治心神不安、肝阳上亢常用。煅后平而涩敛，内服收敛固脱，治滑脱之证每投；外用收湿敛疮，治湿疹湿疮可选。灵磁石（E错）即为磁石，入肝、心经，善镇惊安神、平肝潜阳，治心悸失眠、阳亢眩晕。入肾经，能益肾而聪耳明目、纳气平喘，治肾虚耳鸣、耳聋、目昏、喘促。